可引起肺间皮瘤的粉尘是
A. 石英
B. 滑石
C. 石棉
D. 石墨
E. 煤

正确答案：C。石棉

解析：本题考查间皮瘤的诱发因素。间皮瘤分良性和恶性两类，石棉（C对ABDE错）接触与恶性间皮瘤有关，间皮瘤可发生于胸、腹膜，以胸膜最多见。恶性间皮瘤发生与接触石棉类型有关。